与过期妊娠无关的是
A. 羊水过多
B. 头盆不称
C. 巨大胎儿
D. 雌孕失调
E. 胎盘缺硫酸脂酶

正确答案：A。羊水过多

解析：发生过期妊娠的原因还不明确。引发的可能因素很多，包括黄体酮阻断、催产素刺激剂、胎儿肾上腺皮质激素分泌等，任何因素引起这些激素失调均可导致过期妊娠。所以过期妊娠可能与以下几个因素有关，雌孕激素比例失调（D对）；胎盘缺乏硫酸脂酶（E对），虽然胎儿肾上腺产生了足够的16α-羟基硫酸脱氢表雄酮，但无法将脱氢表雄酮转变为雌二醇及雌三醇，以致雌激素水平过低，发生过期妊娠；头盆不称（B对）和巨大胎儿（C对），使胎先露部不能正常下降，导致过期妊娠。羊水过多与胎膜早破和早产有关，与过期妊娠无关（A错，为本题正确答案）。